眼副器，不包括
A. 眼睑、泪器
B. 睫状体
C. 结膜、眼球外肌
D. 眶脂体
E. 眶筋膜

正确答案：B。睫状体

解析：眼睑、泪器（A对）、结膜、眼球外肌（C对）、眶脂体（D对）、眶筋膜（E对）均属于眼副器，但不包括睫状体（B错，为本题正确答案）。